患者，女，43岁，1周前右上第一前磨牙开始咀嚼痛，伴有右侧眶下区肿痛3天。检查见右眶下肿胀明显、右上第一前磨牙深龋，髓腔暴露，叩诊（+++），前庭沟肿胀，压痛，有波动感。如该患者在2天前来就诊，对该患者最佳的处理是
A. 开髓拔髓、引流
B. 穿刺
C. 局部热敷
D. 拔除患牙
E. 仅口服抗生素

正确答案：A。开髓拔髓、引流

解析：本题考查间隙感染概述、眶下间隙、咬肌间隙感染。此患者的处理应是开髓拔髓、引流（A对），解除患者的感染源，缓解局部压力。